与局限性青少年牙周炎的发生密切相关的是
A. 伴放线放线杆菌
B. 黏性放线菌
C. 中间普氏菌
D. 牙龈卟啉单孢菌
E. 福赛拟杆菌

正确答案：A。伴放线放线杆菌

解析：本题考查局限侵袭性牙周炎的病因。伴放线放线杆菌（A对）与局限性青少年牙周炎的发生密切相关。黏性放线菌（B错）是牙龈炎的发生密切相关。中间普氏菌（C错）与妊娠期龈炎的发生密切相关。牙龈卟啉单孢菌（D错）与慢性牙周炎的发生密切相关。福赛拟杆菌（E错）与慢性牙周炎的发生密切相关。